可见眩晕，肢体震颤，面白无华症状的是
A. 肝阳化风证
B. 阴虚动风证
C. 血虚生风证
D. 热极生风证
E. 肝阳上亢证

正确答案：C。血虚生风证

解析：肝阳化风是由肝阳上亢，肝风内动所致。肝阳上亢，阴不制阳，阳亢化风，故眩晕欲仆，风动筋脉挛急，阴亏筋脉失养，故见肢体震颤，气血壅滞络脉，故见面赤（A错）。阴虚风动是由肝阴亏虚，虚风内动所致。肝阴不足，筋脉失养，筋膜挛急，故见手足震颤、蠕动，或肢体抽搐，阴虚不能上养，故见头晕，阴虚不能制阳，虚热内蒸，故见两颧潮红（B错）。血虚生风是由肝血亏虚，虚风内动所致。肝血不足，不能上荣头面，故见眩晕，面白，肝在体为筋，爪甲为筋之余，筋失血养，故见肢体震颤，手足拘急，肌肉动，肢体皮肤失养，故见肢体麻木（C对）。热极生风是由邪热炽盛而致热极生风，邪热炽盛，燔灼肝经，筋脉拘挛，故见四肢抽搐，颈项强直，角弓反张，热病多面赤（D错）。肝阳上亢证是由肝阴亏虚于下，不能制阳，肝阳亢扰于上所致，肝阳升发太过，血随气逆，冲扰于头，故见眩晕耳鸣，气血上冲，血络充盈，故见面红，无肢体震颤的症状（E错）。